某医师治疗温病血热毒盛之斑疹紫黑喜用紫草，此因紫草除凉血活血外，又能
A. 滋阴
B. 明目
C. 解毒透疹
D. 散结消肿
E. 通络止痛

正确答案：C。解毒透疹

解析：本题考查的是紫草的功效。某医师治疗温病血热毒盛之斑疹紫黑喜用紫草，此因紫草除凉血活血外，又能解毒透疹（C对）。紫草：【功效】凉血活血，解毒透疹。玄参：【功效】清热凉血，滋阴（A错）降火，解毒散结，润肠。桑叶：【功效】疏散风热，清肺润燥，平肝明目（B错），凉血止血。夏枯草：【功效】清肝明目，散结消肿（D错）。大血藤：【功效】清热解毒，活血止痛，祛风通络（E错）。